关于解剖牙冠的说法错误的是
A. 牙体外层被釉质覆盖的部分称为解剖牙冠
B. 解剖牙冠釉质全身矿化组织中最坚硬的牙体组织
C. 解剖牙冠的釉质厚度都是相同的
D. 恒切牙切缘釉质最厚厚度约2.0mm
E. 磨牙牙尖处釉质厚度约为2.5mm

正确答案：C。解剖牙冠的釉质厚度都是相同的

解析：牙体外层被釉质覆盖的部分称为解剖牙冠，其表层釉质是高度钙化的最坚硬的牙体组织，也是全身矿化组织中最坚硬的。其厚度随着牙及牙部位的不同而异。恒切牙切缘釉质最厚约为2.0mm，磨牙牙尖处的釉质最厚约为2.5mm。掌握“牙的组成、分类、功能及牙位记录”知识点。